肾毒性最大、最常见，肾功能不良者宜减量使用的药物是
A. 链霉素
B. 庆大霉素
C. 阿米卡星
D. 妥布霉素
E. 奈替米星

正确答案：B。庆大霉素

解析：本题考查庆大霉素。庆大霉素（B对）肾毒性在同类抗生素中最大，最常见。链霉素（A错）、阿米卡星（C错）、妥布霉素（D错）及奈替米星（E错），肾毒性均小于庆大霉素，其中奈替米星肾毒性是氨基糖苷类中最低的。